男，62岁。近1年来劳累时胸痛，休息或含服硝酸甘油后数分钟即可缓解。既往高血压病史10余年，药物控制满意。实验室检查：血LDL-C2.16mmol/L。改善患者预后的药物不包括
A. 硝酸异山梨酯
B. 辛伐他汀
C. 福辛普利
D. 美托洛尔
E. 阿司匹林

正确答案：A。硝酸异山梨酯

解析：老年男性患者，近1年来劳累时胸痛，休息或含服硝酸甘油后数分钟即可缓解（稳定型心绞痛表现），故患者诊断为稳定型心绞痛。实验室检查：血LDL-C2.16mmol/L 。故改善患者预后的药物不包括硝酸异山梨酯，其只能改善缺血，减轻症状（A对）。辛伐他丁是他汀类药物，所有明确诊断冠心病病人，无论其血脂水平如何，均应给予他汀类药物，并将LDL-C降至1.8mmol/L(70mg/dl）以下水平（B错）。福辛普利是ACEI类药物，可以使冠心病病人的心血管死亡、非致死性心肌梗死等主要终点事件的相对危险性显著降低（C错）。美托洛尔是β受体拮抗剂，对于心肌梗死后的稳定型心绞痛病人，其可能可以减少心血管事件的发生（D错）。阿司匹林是抗血小板治疗的基石，所有病人只要无禁忌都应该使用（E错）。